下列不是健康教育社会诊断常用方法的是
A. 问卷调查
B. 小组讨论
C. 个人访谈
D. 文献资料法
E. 试验法

正确答案：E。试验法